下列有关贵要静脉的说法，正确的是
A. 起自手背静脉网的桡侧
B. 至臂上份注入腋静脉
C. 上行于前臂背侧
D. 与头静脉间无交通支
E. 是临床上行静脉注射的常用血管

正确答案：E。是临床上行静脉注射的常用血管

解析：上肢浅静脉包括头静脉、肘正中静脉、贵要静脉，是临床上行静脉注射的常用血管（E对）。